在体内被水解成羧酸，抑制结核杆菌生长的药物是
A. 异烟肼
B. 异烟腙
C. 盐酸乙胺丁醇
D. 对氨基水杨酸钠
E. 吡嗪酰胺

正确答案：E。吡嗪酰胺

解析：本题考查吡嗪酰胺。在体内被水解成羧酸，抑制结核杆菌生长的药物是吡嗪酰胺（E对）。吡嗪酰胺的作用机制尚不完全清楚，可能与吡嗪酸有关，吡嗪酰胺渗入吞噬细胞后并进入结核菌菌体内，菌体内的酰胺酶使其脱去酰胺基，转化为吡嗪酸而发挥抗菌作用。另因吡嗪酰胺在化学结构上与烟酰胺相似，通过取代烟酰胺而干扰脱氢酶并阻止脱氢作用，妨碍结核菌对氧的利用而影响细菌的正常代谢造成死亡。异烟肼（A错）与菌体的β-酮脂酰载体蛋白合成酶形成复合体，抑制分枝杆菌细胞壁特有的重要成分分枝菌酸的合成，损害了细胞壁的结构完整性和对菌体的屏障保护作用，引起结核分枝杆菌死亡。还可通过抑制结核分枝杆菌的DNA合成或抑制菌体的某些酶，引起菌体代谢紊乱而死亡。异烟腙（B错）为异烟肼衍生物，其作用机理与异烟肼相似。盐酸乙胺丁醇（C错）的作用机制：与菌体内Mg²⁺结合，干扰结核分枝杆菌的RNA合成。还能抑制分枝杆菌的阿拉伯糖基转移酶，阻止分枝杆菌细胞壁成分阿拉伯聚糖的聚合反应，影响菌体细胞壁的合成。
对氨基水杨酸钠（D错）的作用机制：对氨基水杨酸钠为对氨基苯甲酸（PABA）的同类物，通过对叶酸合成的竞争抑制作用而抑制结核分枝杆菌的生长繁殖。